溃疡性结肠炎的溃疡特征
A. 溃疡呈带状，其长径与肠管长轴垂直
B. 纵行溃疡、黏膜呈鹅卵石样病变
C. 病变连续性，弥漫性分布
D. 圆形溃疡，边缘较规整，周围黏膜常充血水肿
E. 地图状溃疡

正确答案：C。病变连续性，弥漫性分布

解析：溃疡性结肠炎的特征为病变呈连续性、弥漫性分布。可表现为多发性糜烂或表浅小溃疡并可累及黏膜下层（C对）。溃疡呈带状，其长径与肠管长轴垂直是肠结核特征（A错）。纵行溃疡、黏膜呈鹅卵石样病变是克罗恩病特征（B错）。圆形溃疡，边缘较规整，周围黏膜常充血水肿是消化性溃疡特征（D错）。地图状溃疡是细菌性痢疾的特征（E错）。